患者，女性，64岁。发现左上牙龈菜花样溃疡2个月，病检诊为“鳞癌I级”。查见溃疡2cm×2cm大小，X线片示溃疡区牙槽突骨质有破坏，颌面颈部未触及明显肿大淋巴结。该患者应选择的最佳治疗方案为
A. 病变区上颌骨区域性扩大切除术加根治性颈清扫术
B. 病变区上颌骨区域性扩大切除术加功能性颈清扫术
C. 病变区上颌骨区域性扩大切除术，定期复查，密切注意颈部淋巴结改变
D. 病变侧上颌骨次全切除术加功能性颈清扫术
E. 病变侧上颌骨全部切除术加功能性颈清扫术

正确答案：C。病变区上颌骨区域性扩大切除术，定期复查，密切注意颈部淋巴结改变

解析：本题考查上颌牙龈癌的治疗。该病例中“鳞癌I级”分化较好，恶性程度较低，根据溃疡2cm×2cm大小及溃疡区牙槽突骨质有破坏，可考虑该牙龈癌处于早期，“颌面颈部未触及明显肿大淋巴结”，可知牙龈癌还未向颈淋巴结转移，故最佳治疗方案为病变区上颌骨区域性扩大切除术，无需行颈淋巴结清扫，定期复诊，密切注意颈部淋巴结改变即可（C对）。该病例中牙龈癌还未向颈淋巴结转移，故无需行颈淋巴结清扫（ABDE错），且病变范围偏小，未见波及上颌窦，因此只需在病变区域扩大切除即可，无需行病变侧上颌骨次全切除（D错）或全部切除（E错）。